血液里出现赫恩小体是哪种毒物中毒的特异性表现
A. 苯
B. 铅
C. 苯胺
D. 氰化氢

正确答案：C。苯胺

解析：本题考查赫恩滋小体的出现情况。赫恩滋小体是苯的氨基硝基化合物（C对ABD错）在体内经代谢转化产生的中间代谢物，除作用于血红蛋白的铁原子和红细胞的GSH外，还可直接作用于珠蛋白分子中的巯基（-SH）,使球蛋白变性。初期仅2个巯基被结合变性，其变性是可逆的；到后期，4个巯基均与毒物结合，变性的珠蛋白在红细胞内形成沉着物，即形成赫恩滋小体。